根据《中华人民共和国行政复议法》，行政复议申请的一般时效和行政复议机关作出行政复议决定的期限分别是
A. 60日，30日
B. 90日，30日
C. 30日，30日
D. 60日，60日
E. 90日，60日

正确答案：D。60日，60日

解析：本题考查的是行政复议程序。根据《中华人民共和国行政复议法》，行政复议申请的一般时效和行政复议机关作出行政复议决定的期限分别是60日，60日（D对）。申请人自应当知道之日起60日内提出行政复议申请。复议机关应当自受理之日起60日内作出行政复议决定，情况复杂的，经复议机关负责人批准，可以适当延长，并告知申请人和被申请人，但是延长期限最多不超过30日。